处方中外文缩写mcg代表
A. 微克
B. 必要时
C. 临睡时
D. 餐后
E. 立即

正确答案：A。微克

解析：本题考查处方中常见的外文缩写及其含义。处方中外文缩写mcg的含义为微克（A对）。处方中外文缩写prn的含义为必要时（B错）（长期备用）。处方中外文缩写sos.的含义为必要时（临时备用）。处方中外文缩写h.s.的含义为临睡时（C错），即睡前服用。处方中外文缩写pc.的含义为餐后（D错）。处方中外文缩写St.的含义为立即（E错）。